可引起中性粒细胞胞浆抗体相关性血管炎的抗甲状腺药是
A. 卡比马唑片
B. 复方碘口服液
C. 甲巯咪唑片
D. 甲状腺片
E. 丙硫氧嘧啶片

正确答案：E。丙硫氧嘧啶片

解析：本题考查丙硫氧嘧啶。可引起中性粒细胞胞浆抗体相关性血管炎的抗甲状腺药是丙硫氧嘧啶片（E对）。丙硫氧嘧啶可引起中性粒细胞胞浆抗体相关性血管炎，发病机制为中性粒细胞聚集，诱导中性粒细胞胞浆抗体。以肾脏受累多见，主要表现为蛋白尿、进行性肾损伤、发热、关节痛、肌痛、咳嗽、咯血等，通常可在停药后缓解，但严重病例需要大剂量糖皮质激素治疗。卡比马唑片（A错）、复方碘口服液（B错）和甲巯咪唑片（C错）三者为抗甲状腺药，均无引起中性粒细胞胞浆抗体相关性血管炎的不良反应。甲状腺片（D错）为甲状腺激素类药。